正常成人每天至少必须排出多少尿液才能清除体内的代谢废物？
A. 800ml
B. 1000ml
C. 500ml
D. 1200ml
E. 1500ml

正确答案：C。500ml

解析：正常成人每天至少必须排出1500ml（C对）尿液才能清除体内的代谢废物。每日需水约1500 -2000ml，每日最低排出的水量为1500ml。